翼颌间隙内主要有
A. 舌神经
B. 下牙槽神经
C. 下牙槽静脉
D. 下牙槽动脉
E. 以上均正确

正确答案：E。以上均正确

解析：翼下颌间隙或称翼颌间隙，间隙内主要有舌神经、下牙槽神经及下牙槽动、静脉通过。掌握“面侧深区及颌面部各间隙的境界”知识点。